女性，58岁。2型糖尿病15年，长期口服格列本脲，10mg/日。查体：血压145/90mmHg，心、肺和腹部检查未见异常，双下肢无水肿。眼底检查，视网膜病变Ⅲ期。空腹血糖6.8mmol/L，餐后2小时血糖10.6mmol/L，血尿素氮6.2mmol/L，血肌酐92.8μmol/L，尿常规检查尿糖50mmol/L，蛋白阴性。糖尿病治疗应选择
A. 磺脲类降血糖药加量
B. 双胍类降血糖药
C. α葡萄糖苷酶抑制剂
D. 噻唑烷二酮类
E. 胰岛素

正确答案：E。胰岛素

解析：糖尿病病史达15年，且并发视网膜病变Ⅲ期，为减少高血糖的进一步损害，应尽快将血糖控制在目标范围（空腹3.9～7.2mmol/L，非空腹≤10mmol/L）内，改用胰岛素治疗（E对）。磺脲类降血糖药（A错）、双胍类降血糖药（B错）、α葡萄糖苷酶抑制剂（C错）、噻唑烷二酮类（D错）均为口服降糖药物，对血糖控制效果不如胰岛素。